葡萄胎患者清宫后最理想的避孕方法是
A. 长效口服避孕药
B. 短效口服避孕药
C. 放置宫内节育器
D. 阴茎套
E. 避孕针

正确答案：D。阴茎套

解析：葡萄胎患者清宫后应可靠避孕一年，最理想的避孕方法是阴茎套（D对），其次是口服避孕药（AB错）和避孕针（E错），不选用宫内节育器（C错），以免混淆子宫出血的原因或造成穿孔。